通常所说的颞下颌“关节内强直”指的不是
A. 真性关节强直
B. 关节内强直
C. 关节内纤维性粘连
D. 关节内骨性粘连
E. 颌间挛缩

正确答案：E。颌间挛缩

解析：颞下颌关节强直是指由于疾病、损伤或外科手术而导致的关节固定、运动丧失。在临床上可分为两类：关节内强直是指关节内发生病变，造成关节内纤维性或骨性粘连；关节外强直是指关节外上下颌间皮肤、黏膜或深层组织发生病变，也被称为假性关节强直。掌握“颞下颌关节强直”知识点。